患者，女，26岁。因心悸、手颤、易饥饿、烦躁易怒前来就诊，实验室检查游离甲状腺素（FT₃，FT₄）增高、促甲状腺素（TSH）降低，诊断为甲状腺功能亢进症。医师处方给予抗甲状腺药治疗。患者用药3个月后，实验室检查：胰岛素自身抗体阳性。最可能与此有关的药物是
A. 普萘洛尔
B. 丙硫氧嘧啶
C. 甲巯咪唑
D. 碳酸锂
E. 复方碘溶液

正确答案：C。甲巯咪唑

解析：本题考查甲巯咪唑的不良反应。甲巯咪唑（C对）可引起胰岛素自身免疫综合征，诱发自身产生胰岛素自身抗体，因分泌的胰岛素与胰岛素自身抗体结合不能发挥其生理作用，于是血糖升高进一步刺激胰岛细胞分泌胰岛素，胰岛素又继续与抗体相结合，使血清中有大量与胰岛素自身抗体结合的胰岛素，但与抗体结合的胰岛素极易解离，在进食后血糖高峰过后，胰岛素逐渐解离，而导致高游离胰岛素血症，诱发低血糖反应。普萘洛尔（A错）用于控制甲状腺功能亢进症的心率过快，也可用于治疗甲状腺危象。丙硫氧嘧啶（B错）不良反应：（1）十分常见药物过敏：皮肤瘙痒、皮疹、药物热、红斑狼疮样综合征（表现为发热、畏寒、全身不适、软弱无力）、剥脱性皮炎、白细胞计数减少、轻度粒细胞计数减少。（2）常见关节痛、白细胞和粒细胞计数减少、中性粒细胞胞浆抗体相关性血管炎、脉管炎。碳酸锂（D错）为抗躁狂药，主要用于治疗躁狂症，对躁狂和抑郁交替发作的双相情感性精神障碍有很好的治疗和预防复发的作用，对反复发作的抑郁症也有预防发作的作用。复方碘溶液（E错）为甲状腺激素合成的原料，用以预防和治疗地方性甲状腺肿。用于甲状腺功能亢进术前准备，使甲状腺变小变硬，血流减少。抑制甲状腺激素释放，治疗甲状腺危象。